关于病因观，错误的是
A. 传染病的病因是单一的
B. 病因来源于环境和宿主
C. 流行病学三角模型包括病因、宿主和环境
D. 病因网络模型有利于病因探索
E. 有果必有因

正确答案：A。传染病的病因是单一的